有关黄斑的描述，错误的是
A. 是视力敏锐的地点
B. 位于视神经盘颞侧
C. 此处无感光细胞，称生理性盲点
D. 此处中央部凹陷，称中央凹，视力最敏锐
E. 此处主要由视锥细胞占据

正确答案：C。此处无感光细胞，称生理性盲点

解析：黄斑位于视神经盘颞侧（B对），主要由视锥细胞占据（E对），且其中央凹陷，称中央凹，无血管走形，是视力最敏锐的地方（AD对）。视神经盘的中央凹陷因无感光细胞分布，且有视网膜中央动、静走行，故被称为生理性盲点（C错，为本题正确答案）。